男性，50岁。因发作性胸前区疼痛1个月入院，静息心电图V₄，V₅，V₆，ST段压低＞2mm，T波倒置。行冠脉造影检查各冠脉血管光滑，无狭窄血流通畅。最可能的诊断是
A. 稳定型心绞痛
B. 不稳定型心绞痛
C. X综合征
D. 变异型心绞痛
E. 心脏神经症

正确答案：C。X综合征

解析：患者中年男性，发作性胸前区疼痛，静息心电图V₄，V₅，V₆，ST段压低＞2mm，行冠脉造影检查各冠脉血管光滑，无狭窄血流通畅，符合X综合症的典型表现，最可能的诊断是X综合征（C对）。稳定型心绞痛（P219）（A错）患者冠状动脉存在固定狭窄或部分闭塞。不稳定型心绞痛（P229）（B错）常有动脉粥样斑块，并伴不同程度表面血栓。变异型心绞痛（P229）（D错）常表现为一过性ST段动态抬高。心脏神经症（E错）亦称心脏神经官能症，以心悸、胸痛、气短、乏力为主要表现，伴有其他神经症为特征，无ST段压低，无T波倒置。